正常小儿后囟闭合的时间一般于生后
A. 3～5周
B. 6～8周
C. 9～11周
D. 12～14周
E. 15～18周

正确答案：B。6～8周

解析：婴儿出生时后囟很小或已经闭合，最晚约6～8周龄闭合（B对）。